伤寒病程中阳性率最高且操作简便的实验室检查是
A. 血培养
B. 尿培养
C. 骨髓培养
D. 粪便培养
E. 玫瑰疹刮取物培养

正确答案：A。血培养

解析：血培养、骨髓培养在伤寒的诊断中阳性率都是比较高的，但是相对来说简便的是血培养（A对）。